下列关于外科疾病总的发病机制的叙述，错误的是
A. 气血凝滞
B. 经络阻塞
C. 邪正盛衰
D. 脏腑失和
E. 热毒火毒

正确答案：E。热毒火毒

解析：局部气血凝滞、营气不从，经络阻塞，以致脏腑功能失和等，是外科疾病总的发病机理。气血凝滞是指气血生化不及或运行障碍而致其功能失常的病理变化。局部经络阻塞是外科疾病总的发病机理之一，同时身体经络的局部虚弱也能成为外科疾病发病的条件，如外伤瘀阻后形成瘀血流注，头皮外伤血肿后常可导致斑秃（油风）的发生等。《素问·至真要大论》说：“诸痛痒疮，皆属于心。”《外科启玄》亦云：“凡疮疡，皆由五脏不和，六腑壅滞，则令经脉不通而生焉。”故有“诸内必形诸外”“诸外必本诸内”之说。因此，外科疾病的发生与脏腑功能失调有关（E错，为本题正确答案）。